某大学二年级学生，因爸爸经常在家抽烟，他从高中就开始尝试吸烟，现在每天都会抽上1-2支。新学期一开始，学校就公布了新的奖励制度，明确规定吸烟学生不得授予奖学金和优秀称号。他便成功戒烟。爸爸经常在家抽烟是导致吸烟的
A. 促进因素
B. 保护因素
C. 危险因素
D. 协同因素
E. 刺激因素

正确答案：C。危险因素